慢性肺源性心脏病心脏形态是
A. 球形
B. 三角形
C. 靴形
D. 主动脉型
E. 二尖瓣型

正确答案：E。二尖瓣型

解析：心脏可失去正常形态，二尖瓣型右或（和）左心缘不同程度向外膨突，心尖上翘，肺动脉凸出，主动脉球较小。常见于二尖瓣狭窄、房间隔缺损、肺动脉瓣狭窄、慢性肺源性心脏病（E对）。球形心见于二尖瓣关闭不全（A错）。三角形心脏烧瓶心是心包积液的特征性表现（B错）。靴形心常见于主动脉关闭不全、主动脉瓣狭窄、高血压性心脏病、法洛四联症（C错）。主动脉型，心脏呈靴形，心腰凹陷，左下缘向左扩张，主动脉球突出。常见于高血压和主动脉瓣病变等以左心室增大为主的心脏病（D错）。